20岁男性，1小时前被菜刀将食指末节掌侧方切去一块皮肤，约1cm×0.5cm，皮下脂肪裸露。治疗应
A. 三角皮瓣移植
B. 游离周围软组织予以覆盖
C. 单纯缝合皮肤
D. 鱼际皮瓣移植
E. 胸部皮瓣移植

正确答案：B。游离周围软组织予以覆盖

解析：患者示指末节掌侧皮肤缺损约1cm×0.5cm，局部组织损伤不重，皮下脂肪裸露，基底部软组织良好，只要游离周围软组织予以覆盖（B对）即可。三角皮瓣移植（A错）、鱼际皮瓣移植（D错）、胸部皮瓣移植（E错）等皮瓣转移修复适用于有肌腱、骨、关节、大血管、神经干等组织裸露的创面。单纯缝合皮肤，张力太大，不利于愈合，且术后容易影响手指功能（C错）。